中成药中含氢氯噻嗪成分重复应用时，可致
A. 急性肾衰竭
B. 膀胱颈梗阻
C. 低血糖
D. 低血钾、低血压
E. 粒细胞减少

正确答案：D。低血钾、低血压

解析：本题考查重复用药。与含有氢氯噻嗪成分的中成药重复用药时，会使氢氯噻嗪服药过量，造成低血钾、低血压（D对）。氢氯噻嗪为利尿药、抗高血压药。长期应用时会导致直立性低血压、低血钾、高血糖症、高尿酸血症等不良反应。